游离胆汁酸包括
A. 胆酸
B. 石胆酸
C. 脱氧胆酸
D. 鹅脱氧胆酸
E. 以上说法均正确

正确答案：E。以上说法均正确

解析：正常人胆汁中的胆汁酸按其结构可分为游离胆汁酸和结合胆汁酸两大类。游离胆汁酸包括胆酸、鹅脱氧胆酸、脱氧胆酸和少量石胆酸4种。掌握“胆汁酸代谢”知识点。